可吸入颗粒物（IP）粒径为
A. ≤0.1μm
B. ≤10μm
C. ≤5μm
D. ≤1μm
E. ≤100μm

正确答案：B。≤10μm

解析：本题考查可吸入颗粒物（IP）的粒径。可吸入颗粒物（IP）指空气动力学直径≤10μm（B对ACDE错）的颗粒物。